男性，42岁，自幼起咳嗽、咳痰、喘息，多为受凉后发作，静滴“青霉素”可缓解，10-20岁无发作。20岁后又有1次大发作，发作时大汗淋漓、全身发紫、端坐不能平卧，肺部可闻及哮鸣音，静脉推注“氨茶碱地塞米松”可完全缓解。自后反复出现夜间轻微喘息，每周发作3次以上，不能入睡，PEF变异率为35%。查体：双肺听诊未闻及干湿啰音，心率89次/分。根据病情程度选择药物治疗最佳方案是
A. 每日吸入氨茶碱+静滴β₂受体激动剂
B. 每日雾化吸入β₂受体激动剂+静滴氨茶碱
C. 每日雾化吸入抗胆碱药+口服β₂受体激动剂
D. 每日吸入糖皮质激素+吸入β₂受体激动剂
E. 每日定量吸入糖皮质激素+静滴β₂受体激动剂

正确答案：D。每日吸入糖皮质激素+吸入β₂受体激动剂

解析：中年男性患者，自幼出现咳嗽咳痰喘息，发作时可闻及哮鸣音（为支气管哮喘的典型表现），静注“氨茶碱地塞米松”可完全缓解，PEF变异率为35%，由此考虑该患者为支气管哮喘。该患者没有哮喘的急性发作，但是在相当长的时间内仍有不同频度和不同程度的喘息等症状，故最可能的诊断为支气管哮喘非急性发作期。患者处于支气管哮喘非急性发作期未控制水平（每周发作3次以上），治疗应从3级方案开始，应选择每日吸入糖皮质激素+吸入长效β2受体激动剂（D对）。氨茶碱用法有口服和静滴，不能雾化吸入（A错）。短效抗胆碱药用于急性发作，而长效抗胆碱药主要用于哮喘合并慢阻肺及慢阻肺患者的长期治疗，并且目前只有干粉吸入剂（B错）。β₂受体激动剂首选吸入给药（CE错）。